对革兰阳性菌、革兰阴性菌、厌氧菌以及非厌氧菌均有强化作用的抗菌药物是
A. 头孢吡肟
B. 头孢西丁
C. 拉氧头孢
D. 氨曲南
E. 美罗培南

正确答案：E。美罗培南

解析：本题考查美罗培南。美罗培南（E对）是抗菌谱最广的β-内酰胺类药物，对革兰阳性菌、革兰阴性菌、厌氧菌以及非厌氧菌均有强化作用。头孢吡肟（A错）对革兰阳性菌、革兰阴性菌、厌氧菌显示广谱抗菌活性。头孢西丁（B错）对大多数超广谱β-内酰胺酶稳定，且对拟杆菌属等厌氧菌具有抗菌活性。拉氧头孢（C错）对多种革兰阴性菌及厌氧菌有较强作用，对β-内酰胺酶稳定。氨曲南（D错）对需氧革兰阴性菌具有抗菌活性。